某女，32岁，口舌生疮，烦躁焦虑，口干舌燥，小便短赤。舌尖红，苔薄黄，脉数。口舌生疮，舌尖红，病位在
A. 心
B. 肝
C. 胃
D. 肺
E. 肾

正确答案：A。心

解析：本题考查的是心火亢盛的临床表现及辨证要点。口舌生疮，烦躁焦虑，口干舌燥，小便短赤。舌尖红，苔薄黄，脉数。口舌生疮，舌尖红，病位在（A对）。心火亢盛的临床表现，多见心中烦热，急躁失眠，口舌糜烂疼痛，口渴，舌红，脉数，甚则发生吐血、衄血。心火亢盛证以心及舌、脉等有关组织出现实火内炽的症状为辨证要点。1.心病主要证候有心气虚证、心阳虚证、心血虚证、心阴虚证、心血瘀阻证及心火亢盛证。2.肺（D错）病主要证候有肺气虚证、肺阴虚证、风寒犯肺证、风热犯肺证、燥热犯肺证及痰浊阻肺证。3.脾病的主要证候有脾气虚证、脾阳虚证、寒湿困脾证及脾胃湿热证。4.肝（B错）病主要证候有肝气郁结证、肝火上炎证、肝阳上亢证、肝风内动证、肝阴虚证、肝血虚证、肝胆湿热证及寒滞肝脉证。5.肾（E错）病的主要证候有肾阳虚证、肾阴虚证、肾精不足证、肾气不固证及肾不纳气证。胃（C错）病的主要证候胃寒证、胃热（火）证、食滞胃脘证、胃阴虚证。